不属于淋巴器官的是
A. 扁桃体
B. 淋巴结
C. 胸腺
D. 甲状腺
E. 脾

正确答案：D。甲状腺

解析：淋巴器官包括淋巴结（B对）、胸腺（C对）、脾（E对）和扁桃体（A对），甲状腺是人体最大的内分泌腺，不输于淋巴器官（D错，为本题正确答案）。